盐酸溴己新含有
A. 吗啡喃结构
B. 苯吗喃结构
C. 哌啶结构
D. 氨基酮结构
E. 环己基胺结构

正确答案：E。环己基胺结构

解析：本题考查祛痰药溴己新。祛痰药溴己新结构中含有环己基胺（E对），在体内可发生环己烷羟基化、N-去甲基而产生活性代谢产物氨溴索。盐酸溴己新不含吗啡喃结构（A错）、苯吗喃结构（B错）、氨基酮结构（D错）、哌啶结构（E错）。